治疗前庭大腺炎寒凝瘀滞证，应首选
A. 阳和汤
B. 少腹逐瘀汤
C. 温经汤《金匮》
D. 桂枝茯苓丸
E. 内补丸

正确答案：A。阳和汤

解析：前庭大腺炎寒凝痰瘀证首选温经散寒，涤痰化瘀之阳和汤（A对）。少腹逐瘀汤（B错）主治寒气凝滞疏泄不畅，血瘀不适之少腹淤血积块疼痛症。温经汤（C错）具有温经散寒，养血祛瘀功效，主治冲任虚寒证。桂枝茯苓丸（D错）具有活血、化瘀、消幑之功效，主治子宫肌瘤、经行腹痛或产后恶露。内补丸（E错）功在温肾助阳，涩精止带，用于肾阳虚损之慢性宫颈炎症。